流行病学的作用不是用于
A. 研究统计资料的分析
B. 研究疾病的流行因素
C. 研究疾病预防措施的效果
D. 研究疾病和规划保健工作
E. 研究疾病的自然史

正确答案：A。研究统计资料的分析

解析：本题考查流行病学的作用。研究统计资料的分析（A错，为本题的正确答案）属于统计学的范畴，不属于流行病学的作用。流行病学的作用包括：1.用于研究疾病的流行因素（B对）和病因；2. 用于研究疾病预防和疾病监测；3. 用于考核疾病防治效果（C对）；4. 用于研究和评价保健工作（D对）及其规划；5. 用于研究疾病自然史（E对）。